根据《中国药典》，关于贮藏要求的说法，正确的是
A. 遮光系指避免日光直射
B. 避光系指用不透光的容器包装
C. 密闭系指将容器密闭，以防止尘土与异物的进入
D. 密封系指将容器熔封，以防止空气与水分的进入
E. 阴凉处系指贮藏处温度不超过10℃

正确答案：C。密闭系指将容器密闭，以防止尘土与异物的进入

解析：本题考查药品贮藏的相关要求。 密闭：系指将容器密闭，以防止尘土及异物进入（C对）。遮光系指用不透光的容器包装，例如棕色容器遮光 或黑色包装材料包裹的无色透明、半透明容器（A错）。避光系指避免日光直射（B错）。密封系指将容器密封，以防止风化、吸潮、挥发密封或异物进入（D错）。阴凉处系指不超过20℃（E错）。